某妇女的末次月经是在2003年11月30日。她的经期可能为
A. 3～5天
B. 11天
C. 13天
D. 29天
E. 30天

正确答案：A。3～5天

解析：本题考查女性生殖系统生理。经期一般为2～8日，多为4～6日（A对）。